大脑动脉环组成
A. 大脑前动脉、前交通动脉、大脑后动脉、后交通动脉吻合而成
B. 大脑前动脉、大脑后动脉、大脑中动脉吻合而成
C. 大脑前动脉、大脑后动脉、颈内动脉吻合而成
D. 大脑前动脉、前交通动脉、大脑后动脉、后交通动脉、颈内动脉吻合而成
E. 无

正确答案：D。大脑前动脉、前交通动脉、大脑后动脉、后交通动脉、颈内动脉吻合而成

解析：大脑动脉环由大脑前动脉、前交通动脉、大脑后动脉、后交通动脉、颈内动脉吻合而成（D对ABC错）。